苯二氮䓬类药物的作用特点是
A. 作用部位主要在脑干网状结构
B. 对大脑损伤引起的肌肉僵直无作用
C. 小剂量药物无抗焦虑作用
D. 停药后代偿性反跳较明显
E. 对快动眼睡眠时相影响较小

正确答案：E。对快动眼睡眠时相影响较小

解析：苯二氮䓬类属于镇静催眠药，其药理作用和临床应用：1.抗焦虑作用（C错），通过对边缘系统中的BZ受体的作用而实现的（A错），对各种原因引起的焦虑均有显著疗效，主要用于焦虑症。2.镇静催眠作用，能明显缩短入睡时间，显著延长睡眠持续时间，减少觉醒次数；主要延长非快动眼睡眠的第2期，对快动眼睡眠的影响较小（E对）；其依赖性和戒断症状较轻微（D错）。3.抗惊厥、抗癫痫作用，临床可用于辅助治疗破伤风、子痫、小儿高热惊厥及药物中毒性惊厥。4.中枢性肌肉松弛作用，苯二氮䓬类有较强的肌肉松弛作用，可缓解动物的去大脑僵直，也可缓解人类大脑损伤所致的肌肉僵直（B错）。